按中医五味理论，具有苦能清泄的中药是
A. 芒硝
B. 大黄
C. 牛膝
D. 栀子
E. 苦杏仁

正确答案：D。栀子

解析：本题考查的是五味对人体的效果。按照中医五味理论，具有苦能清泻的中药是栀子（D对）。苦：能泄、能燥、能坚。其中，能泄的含义有三：一指苦能通泄，如大黄（B错）苦寒，功能泻热通便，治热结便秘每用。二指苦能降泄，如苦杏仁（E错）味苦降泄肺气，治咳喘气逆必投；代赭石味苦而善降逆，治呃逆呕喘常选。三指苦能清泄，如黄连、栀子味苦，能清热泻火，治火热内蕴或上攻诸证宜择。能燥即指苦能燥湿，如治寒湿的苍术、厚朴，治湿热的黄柏、苦参等，均为苦味。能坚的含义有二：一指苦能坚阴，意即泻火存阴，如黄柏、知母即是；二指坚厚肠胃，如投用少量苦味的黄连，有厚肠止泻作用等。苦味药大多能伤津、伐胃，津液大伤及脾胃虚弱者不宜大量用。芒硝（A错）治热结便秘，具咸味。牛膝（C错）苦、甘、酸，苦能降泄，甘酸能补。